女，28岁。结节性甲状腺肿10年，近半年出现怕热多汗。T₃、T₄值高于正常值近1倍。妊娠4个月，有哮喘史。最适合的治疗方法是
A. 抗甲状腺药物治疗
B. 普萘洛尔治疗
C. 碘剂治疗
D. 放射性碘治疗
E. 甲状腺大部切除术

正确答案：E。甲状腺大部切除术

解析：青年女性患者，结节性甲状腺肿10年，近半年出现怕热、多汗（甲亢的典型临床表现）。实验室检查：T3、T4值高于正常值近1倍（甲状腺毒症，支持甲亢诊断）。综合该患者的病史及实验室检查，诊断考虑结节性甲状腺肿继发功能亢进，存在手术指征。甲亢对妊娠可造成不良影响，引起流产、早产、胎儿宫内死亡、妊娠期高血压综合征等，而妊娠又可能加重甲状腺功能亢进，因此，妊娠4～6个月的甲亢应考虑手术治疗。综上所述，该患者最适合的治疗方法是甲状腺大部切除术（E对）。妊娠中期（4～6个月）甲亢可选择甲巯咪唑治疗甲亢，但该患者已存在手术指征，因此抗甲状腺药物治疗（A错）不是最适合的治疗方法。普萘洛尔为β受体阻滞剂，可降低甲亢患者的心率，但患者有哮喘史，禁忌用普萘洛尔治疗（B错）。碘剂用于甲状腺手术术前准备或治疗甲状腺危象，否则禁用碘剂治疗（C错）。放射性碘治疗（D错）禁用于妊娠期妇女，系因¹³¹I可进入胎盘，影响胎儿的生长发育。